下列哪项一般不会引起全口义齿基托折裂
A. （牙合）力不平衡
B. 基托较薄
C. 牙槽骨继续吸收
D. 基托与黏膜不贴合
E. 垂直距离恢复的不够

正确答案：E。垂直距离恢复的不够

解析：本题考查全口义齿基托折裂的原因。尽管垂直距离恢复不够，咀嚼时用力较大，但是咀嚼效能较低，且受力仍然较均匀，所以不易造成基托折裂（E错，为本题的正确答案）。（牙合）力不平衡容易造成（牙合）力较大的一侧义齿基托折断（A对）。基托较薄，抗力差，易折裂（B对）。由于牙槽嵴的吸收（C对），使基托组织面与组织之间不密合（D对），受力不均匀，且形成支点，义齿有翘动而使义齿折裂。